脓液有甜腥臭味的是
A. 大肠杆菌
B. 拟杆菌
C. 绿脓杆菌
D. 溶血性链球菌
E. 金黄色葡萄球菌

正确答案：C。绿脓杆菌

解析：大肠杆菌（A错）感染的特点是脓液稠厚、有臭味。拟杆菌（B错）感染的特点是脓液有特殊的恶臭。绿脓杆菌（C对）感染脓液的特点为淡绿色，有特殊的甜腥臭味。溶血性链球菌（D错）感染特点是脓液稀薄、量大、淡红色。金黄色葡萄球菌（E错）感染的特点是脓液稠厚、黄色、无臭味。